男，65岁。睡醒后发现右侧肢体无力，伴言语不利1小时。有高血压病史10年，未规律服药治疗。否认有糖尿病及血脂异常史，神经系统查体：神志清楚，运动性失语，右侧肢体肌力0级，两侧痛、温觉对称，右侧Babinski征（+）。头颅CT检查未见异常。最可能的诊断是
A. 蛛网膜下腔出血
B. 缺血性卒中
C. 脑肿瘤
D. 脑出血
E. 脑炎

正确答案：B。缺血性卒中

解析：老年男性患者，既往有高血压病史，未规律服药治疗，睡醒后发现右侧肢体无力，伴言语不利1小时。神经系统查体：神志清楚，运动性失语，右侧肢体肌力0级，两侧痛、温觉对称，右侧Babinski征（+），头颅CT检查未见异常，根据患者的病史、临床症状及体征，考虑最可能的诊断为缺血性卒中（B对），蛛网膜下腔出血（A错）多为中青年患者突发的剧烈头痛，且CT上各个脑池内可显示高密度出血征象，脑肿瘤（C错）在CT上可有明显的占位征象，脑出血（D错）患者CT上显示高密度出血征象，而该患者头颅CT检查未见异常。脑炎（E错）患者主要临床表现是发热、恶心、头晕及四肢乏力，严重者可有意识障碍。